人群平均需要量即为其RDA的是
A. 蛋白质
B. 热能
C. 脂肪
D. 无机盐
E. 维生素

正确答案：B。热能